医务工作者崇高的职业道德境界
A. 只体现在认识疾病的活动中
B. 只体现在治疗疾病的活动中
C. 只体现在认识疾病、治疗疾病的活动中
D. 只体现在家庭生活中
E. 与医学研究无关

正确答案：C。只体现在认识疾病、治疗疾病的活动中

解析：医务工作者崇高的职业道德境界是指医务人员经过医德修养后医学伦理素质所达到的水平、医德情操所达到的程度。崇高的职业道德境界，不仅体现在认识疾病的活动中（A错），更体现在治疗疾病的活动中（C对B错），与医学研究有相当密切的联系（E错）。医务工作者崇高的职业道德境界与家庭生活无关（D错）。